男，75岁。反复咳嗽、咳痰、喘憋40余年，加重伴发热3天。查体：R24次/分。BP145/85mmHg，昏睡，颈静脉怒张，双肺散在哮鸣音，双下肺可闻及湿性啰音，心率128次/分，双下肢轻度凹陷性水肿。该患者目前应首先进行的检查是
A. 眼底镜
B. 肝肾功能+电解质
C. 动脉血气分析
D. UCG
E. 头颅CT

正确答案：C。动脉血气分析

解析：老年男性，反复咳嗽、咳痰、喘憋40余年（慢阻肺病史），加重伴发热3天（感染史），查体呼吸24次/分（正常静息状态下呼吸12～20次/分）。血压145/85mmHg（单纯收缩期高血压），心率128次/分（正常成年人心率60～100次/分），昏睡，颈静脉怒张，双肺散在哮鸣音，双下肺可闻及湿性啰音，双下肢轻度凹陷性水肿（肺、心功能失代偿期临床表现），根据患者的病史、查体结果、临床表现，最可能的诊断是肺源性心脏病，肺心病心肺功能失代偿期可出现低氧血症、呼吸衰竭、高碳酸血症，该患者目前应首先进行的检查是动脉血气分析（C对），根据动脉血气分析结果进行紧急治疗，缓解缺氧和酸碱平衡失调。眼底镜（A错）多用于高血压眼底病变和糖尿病视网膜病变诊断的辅助检查。肝肾功能+电解质（B错）多用于多种病因导致的原发或继发肝肾疾病的检查。UCG（D错）即超声心动检查，用于心脏和大血管结构和功能的检查，对心肌病、心脏瓣膜病、急性心梗并发症等有重要的诊断价值。头颅CT（E错）用于颅内肿瘤、脑血管疾病、脑外伤等的诊断。